性寒，既消痰下气，又平肝镇惊的药是
A. 竹沥
B. 竹叶
C. 礞石
D. 海浮石
E. 天竺黄

正确答案：C。礞石

解析：本题考查的是礞石的性味归经与功效。性寒，既消痰下气，又平肝镇惊的药是礞石（C对）。礞石：【功效】消痰下气，平肝镇惊。竹沥（A错）：【功效】清热滑痰。竹叶（B错）：【功效】清热除烦，生津，利尿。海浮石（D错）：【功效】清热化痰，软坚散结，通淋。天竺黄（E错）：【功效】清热化痰，清心定惊。